在代谢性酸中毒原因中例外的是
A. 肾功能衰竭
B. 休克
C. 长期不进食
D. 严重腹泻
E. 低血钾

正确答案：E。低血钾

解析：低血钾（E错，为本题正确答案）时细胞外的 H向细胞内移动，可发生代谢性碱中毒。肾功能衰竭（A对）导致排酸保碱功能障碍，休克（B对）使细胞内糖的无氧酵解增强而引起乳酸增加，长期不进食（C对）大量动用脂肪供能，可出现酮症酸中毒，严重腹泻（D对）可引起NaHC03大量丢失，这些因素都会导致代谢性酸中毒